皮样囊肿是由
A. 肿瘤细胞增殖分裂形成
B. 胚胎发育时期遗留于组织中的上皮细胞发展而形成
C. 胚胎发育时内胚叶细胞遗留发展而形成
D. 皮质腺囊肿扩展形成
E. 胚胎发育时皮脂腺、汗腺异常发育而形成

正确答案：B。胚胎发育时期遗留于组织中的上皮细胞发展而形成

解析：皮样囊肿或表皮样囊肿为胚胎发育时期遗留于组织中的上皮细胞发展而形成囊肿；后者也可以由于损伤、手术使上皮细胞植入而形成。皮样囊肿囊壁较厚，由皮肤和皮肤附件所构成。囊腔内有脱落的上皮细胞、皮脂腺、汗腺和毛发等结构，中医称为“发瘤”。囊壁中无皮肤附件者，则为表皮样囊肿。掌握“皮脂腺、皮样或表皮样囊肿”知识点。